与牙周破坏无关的细菌成分是
A. 菌体表面物质
B. 细菌分泌的胶质酶和透明质酸酶
C. 细菌毒素
D. 细菌代谢产物
E. 细菌的菌体大小和形态

正确答案：E。细菌的菌体大小和形态

解析：本题考查与牙周破坏有关的细菌成分。细菌的菌体大小和形态（E错，为本题正确答案）不属于细菌成分，不会造成牙周组织的破坏。细菌即使本身尚未侵入牙周组织，它的菌体表面物质（A对）、抗原成分、各种酶如胶质酶和透明质酸酶（B对）、毒素（C对）及代谢产物（D对）可进入，直接破坏牙周组织，或引起牙周组织的免疫和炎症反应，造成组织损伤。